《中小学校建筑设计规范》要求，黑板宽度中小学均不应小于
A. 0.8m
B. 0.9m
C. 1.0m
D. 1.2m
E. 1.5m

正确答案：C。1.0m